关于药品批发企业收货与验收活动管理要求的说法，正确的有
A. 药品到货时，应当核实运输方式是否符合要求，并对照随货同行单和采购记录核对药品
B. 到货药品出现破损、污染、渗液等包装异常的，应当开箱检查至最小包装
C. 冷藏、冷冻药品应当在冷库中待验
D. 对到货药品应逐件检查并验收，外包装完整的，可不开箱检查

正确答案：A、B、C。药品到货时，应当核实运输方式是否符合要求，并对照随货同行单和采购记录核对药品；到货药品出现破损、污染、渗液等包装异常的，应当开箱检查至最小包装；冷藏、冷冻药品应当在冷库中待验

解析：本题考查的是药品批发企业的收货与验收。关于药品批发企业收货与验收活动管理要求的说法，正确的有药品到货时，应当核实运输方式是否符合要求，并对照随货同行单和采购记录核对药品（A对）；到货药品出现破损、污染、渗液等包装异常的，应当开箱检查至最小包装（B对）；冷藏、冷冻药品应当在冷库中待验（C对）。药品批发企业的收货与验收：（1）收货程序：企业应当按照规定的程序和要求对到货药品逐批进行收货、验收，防止不合格药品入库。药品到货时，收货人员应当核实运输方式是否符合要求，并对照随货同行单（票）和采购记录核对药品，做到票、账、货相符。随货同行单（票）应当包括供货单位、生产厂商、药品的通用名称、剂型、规格、批号、数量、收货单位、收货地址、发货日期等内容，并加盖供货单位药品出库专用章原印章。收货人员对符合收货要求的药品，应当按品种特性要求放于相应待验区域，或者设置状态标志，通知验收。冷藏、冷冻药品到货时，应当对其运输方式及运输过程的温度记录、运输时间等质量控制状况进行重点检查并记录，不符合温度要求的应当拒收。冷藏、冷冻药品应当在冷库内待验。（2）检验报告书：验收药品应当按照药品批号查验同批号的检验报告书。供货单位为批发企业的，检验报告书应当加盖其质量管理专用章原印章。检验报告书的传递和保存可以采用电子数据形式，但应当保证其合法性和有效性。（3）验收抽样：企业应当对每次到货的药品进行逐批抽样验收，抽取的样品应当具有代表性：同一批号的药品应当至少检查一个最小包装，但生产企业有特殊质量控制要求或者打开最小包装可能影响药品质量的，可不打开最小包装；破损、污染、渗液、封条损坏等包装异常以及零货、拼箱的，应当开箱检查至最小包装；外包装及封签完整的原料药、实施批签发管理的生物制品，可不开箱检查（D错）。验收人员应当对抽样药品的外观、包装、标签、说明书以及相关的证明文件等逐一进行检查、核对；验收结束后，应当将抽取的完好样品放回原包装箱，加封并标示。特殊管理的药品应当按照相关规定在专库或者专区内验收。（4）验收记录：验收药品应当做好验收记录，包括药品的通用名称、剂型、规格、批准文号、批号、生产日期、有效期、生产厂商、供货单位、到货数量、到货日期、验收合格数量、验收结果等内容。验收人员应当在验收记录上签署姓名和验收日期。中药材验收记录应当包括品名、产地、供货单位、到货数量、验收合格数量等内容。中药饮片验收记录应当包括品名、规格、批号、产地、生产日期、生产厂商、供货单位、到货数量、验收合格数量等内容，实施批准文号管理的中药饮片还应当记录批准文号。验收不合格的还应当注明不合格事项及处置措施。（5）库存记录：企业应当建立库存记录，验收合格的药品应当及时入库登记；验收不合格的，不得入库，并由质量管理部门处理。（6）委托验收：企业进行药品直调的，可委托购货单位进行药品验收。购货单位应当严格按照药品GSP的要求验收药品，并建立专门的直调药品验收记录。验收当日应当将验收记录相关信息传递给直调企业。